患者女，25岁。风心病二尖瓣狭窄，近来感冒后病情加重，心悸，胸闷，气短，心率110次/分，此外还可能出现的症状是
A. 枪击音，毛细血管搏动
B. 收缩压高，脉压增大
C. 呼吸困难，咳嗽，咯血
D. 低热，气急，心尖搏动向左下移动
E. 胸痛，晕厥，水冲脉

正确答案：C。呼吸困难，咳嗽，咯血

解析：患者风心病二尖瓣狭窄近来感冒后病情加重，心悸，胸闷，气短，心率110次/分此外还可能出现的症状是呼吸困难，咳嗽，咯血（C对）。动脉导管未闭患者出现周围血管征主要表现为水冲脉，另外可有毛细血管搏动征、枪击音等（AE错）。类风湿性心脏病出现收缩压高，脉压增大，是由于心脏的造血功能出现障碍（B错）。左心室肥大或主动脉狭窄可导致低热，气急，心尖搏动向左下移动（D错）。